可做乳膏剂防腐剂的是
A. 黄凡士林
B. 甘油
C. 羟苯乙酯
D. 月桂醇硫酸钠
E. 乙醇

正确答案：C。羟苯乙酯

解析：本题考查乳膏剂的基质与附加剂。羟苯乙酯（C对）为防腐剂；甘油（B错）为保湿剂；黄凡士林（A错）为油脂型基质；月桂醇硫酸钠（D错）为乳化剂；乙醇（E错）不可作为防腐剂。